《药品非临床试验管理规范》的英文缩写为
A. GLP
B. GUP
C. GEP
D. GRP
E. GCP

正确答案：A。GLP

解析：本题考查《药品非临床试验管理规范》的英文缩写。《药品非临床试验管理规范》的英文缩写为GLP（A对）。GUP（B错）是《药品使用质量管理规范》的英文缩写。GCP（E错）是《药物临床试验质量管理规范》的英文缩写。